1990年盖洛普民意调查表明：美国人民心目中最诚实和最道德的职业排序，在第一位的是
A. 医师
B. 药师
C. 护师
D. 口腔医师
E. 大学教授

正确答案：B。药师